静脉滴注时需要严格监控尿量在25ml/h以上的药物是
A. 去甲肾上腺素
B. 肾上腺素
C. 多巴胺
D. 异丙肾上腺素
E. 乙酰胆碱

正确答案：A。去甲肾上腺素

解析：去甲肾上腺素滴注时间过长或剂量过大能够导致急性肾衰竭，产生少尿、无尿和肾实质损伤，故用药期间尿量应保持在25ml/h以上。掌握“多巴胺和异丙肾上腺素”知识点。